机体处于应激如创伤手术感染等情况下，能量代谢的变化中，错误的是
A. 机体出现高代谢和分解代谢
B. 脂肪动员加速
C. 蛋白质分解加速
D. 处理葡萄糖能力增强
E. 机体处于负氮平衡

正确答案：D。处理葡萄糖能力增强

解析：机体处于应激情况下时，出现高代谢和分解代谢（A对），机体糖异生作用增强，脂肪动员加速（B对），蛋白质分解加速（C对），形成负氮平衡（E对），但机体对葡萄糖的处理能力降低（D错，为本题正确答案），从而造成高血糖。